热痛冷缓解可见于
A. 急性浆液性牙髓炎
B. 急性化脓性牙髓炎
C. 慢性牙髓炎
D. 牙髓钙化
E. 可复性牙髓炎

正确答案：B。急性化脓性牙髓炎

解析：本题考查急性牙髓炎的临床表现。急性化脓性牙髓炎（B对）可表现为“热痛冷缓解”，发生急性化脓性牙髓炎时，牙髓的病变产物中有气体出现，受热膨胀后使得髓腔压力进一步增高，产生剧痛；反之冷空气或者凉水可使气体体积收缩减小压力而缓解疼痛。急性浆液性牙髓炎（A错），对冷热刺激敏感，可以有冷热刺激痛，但没有热痛冷缓解，不符合题干。慢性牙髓炎（C错），病程较长，患者可诉有很长时间的冷、热刺激痛史，而没有热痛冷缓解。牙髓钙化（D错），一般没有临床症状，个别情况可出现与体位有关的自发痛，与温度刺激无关。可复性牙髓炎（E错），牙髓血管扩张充血，当患牙受到冷热温度刺激或甜、酸化学刺激时，立即出现瞬间的疼痛反应，尤其对冷刺激更敏感，刺激一去除，疼痛随即消失，并没有热痛冷缓解。